男性，69岁。左侧舌根疼痛3天，影响进食。口腔检查：全口仅余留左下6，残冠。缺失牙已义齿修复。左侧舌根部见1个直径1cm的溃疡，触痛明显。合适的处理是
A. 溃疡切除
B. 拔除左下6
C. 化疗
D. 磨除左下6锐利边缘
E. 强的松加利多卡因溃疡基底部浸润注射

正确答案：B。拔除左下6

解析：本题考查创伤性溃疡的疾病管理。患者全口仅余留左下6残冠，左下6残冠刺激舌体组织，继而在对应的左侧舌根部出现溃疡，根据患者的临床表现和口腔检查可知患者左侧舌根部为创伤性溃疡。对于创伤性溃疡的治疗去除刺激因素是首要措施，即拔除左下6（B对），去除刺激因素后溃疡往往很快明显好转或愈合。溃疡切除（A错）会对舌体组织造成损伤，且残冠未去除，刺激因素持续存在，溃疡久而不愈。化疗（C错）是化学药物治疗的简称，是利用化学药物阻止癌细胞的增殖、浸润、转移，直至最终杀灭癌细胞的一种癌症治疗方式，创伤性溃疡不属于癌症，故不宜用化疗。全口仅余留左下6残冠，并未提及左下6是否有过锐的边缘嵴，且缺失牙已做义齿修复，患牙无存留价值又易引起舌体创伤，故直接拔除即可，不必对其磨除锐利边缘（D错）。强的松加利多卡因溃疡基底部浸润注射（E错）起消炎镇痛的作用，但治标不治本，仅能缓解患者疼痛，应该从源头上采取措施治疗创伤性溃疡。